关于自然流产的症状，下列哪项是错误的
A. 妊娠13周后，先阴道流血后腹痛
B. 晚期流产一般出血不多
C. 妊娠8～12周阴道流血较多
D. 妊娠8周前出血不多
E. 妊娠8周后不完全流产较多

正确答案：A。妊娠13周后，先阴道流血后腹痛

解析：妊娠不足28周、胎儿体重不足1000g而终止称流产。流产的主要症状是阴道流血和腹痛。晚期流产时，一般出血不多，特点是往往先有腹痛，然后出现阴道流血。血逐渐停止，腹痛逐渐消失。妇科检查宫颈口已关闭，子宫接近正常大小。本例A明显错误。掌握“自然流产”知识点。